我国判断肥胖的标准是BMI值大于或等于
A. 18.5
B. 24
C. 25
D. 28
E. 30

正确答案：D。28

解析：本题考查我国判断肥胖的标准。我国成人BMI的标准是：BMI＜18.5为消瘦，18.5～23.9为正常，24.0～27.9为超重，≥28.0（D对ABCE错）为肥胖。